男，38岁。心悸，多汗，食欲亢进2个月。体重下降3kg，大便2次/日，糊状。昨夜聚餐，大量饮用可乐，今晨起乏力，下肢无法活动。查体：T37.1℃，P108次/分，R18次/分，BP145/70mnHg，双肺呼吸音淸，未闻及干湿性啰音，心律齐，腹软，无压痛。双下肢肌力1级，肌张力明显减弱。实验室检查：血K⁺＜2.8mmol/L，Na⁺140mmol/L，Glu6.4mmol/L。下列检查对明确病因意义最大的是
A. 肾上腺皮质功能
B. 甲状腺功能
C. 血儿茶酚胺
D. OGTT试验
E. 血气分析

正确答案：B。甲状腺功能

解析：该患者为青年男性，有心悸、多汗、食欲亢进、大便次数增多、腹泻、体重下降（甲亢的临床表现），心率108次/分（增快，正常为60～100次/分）、血压145/70mmHg（一级高血压，正常值低于120/80mmHg）等甲亢体征，双下肢肌力1级，肌张力明显减弱，血K⁺＜2.8mmol/L（降低，正常值3.5～5.5mmol/L），为甲亢伴发的周期性瘫痪和甲亢性肌病。综合该患者病史及实验室检查，诊断为甲亢。明确病因最有意义的检查是甲状腺功能检查（B对）。肾上腺皮质功能检查（A错）主要用于肾上腺皮质疾病如库欣综合征、原发性醛固酮增多症、Addison病的诊断。血儿茶酚胺测定（C错）可以用于嗜铬细胞瘤的诊断（P711）。OGTT试验（D错）为口服葡萄糖耐量试验，在无摄入任何热量8小时后，清晨空腹进行，成人口服75g无水葡萄糖，溶于250～300ml水中，5～10分钟内饮完，空腹及开始饮葡萄糖水后两小时测静脉血浆葡萄糖。用于糖尿病的诊断（P732）。血气分析（E错）对判断呼吸衰竭和酸碱失衡的严重程度及指导治疗均具有重要意义（P139）。